抗心律失常药的I类——钠通道阻滞药又分为三个亚类，下列说法错误的是
A. Ia类有奎尼丁
B. Ib类为轻度阻滞钠通道药物
C. Ic类为适度阻滞钠通道
D. Ib类有利多卡因
E. Ic类有普罗帕酮

正确答案：C。Ic类为适度阻滞钠通道

解析：抗心律失常药的I类——钠通道阻滞药又分为三个亚类，即Ia、Ib、Ic：Ia类适度阻滞钠通道。本类药有奎尼丁、普鲁卡因胺等；Ib类轻度阻滞钠通道。本类药有利多卡因、苯妥英等；Ic类明显阻滞钠通道。本类药有普罗帕酮、氟卡尼等。掌握“抗心律失常药”知识点。